HIV感染导致大量减少的细胞是
A. 单核细胞
B. CD8⁺T细胞
C. 粒细胞
D. NK细胞
E. CD4⁺T细胞

正确答案：E。CD4⁺T细胞

解析：CD4⁺T分子是HIV主要受体，当HIV进入人体后，嵌于病毒包膜上的gp120与CD4⁺T细胞膜上的CD4⁺T受体结合，病毒复制的同时可直接导致受感染CD4⁺T细胞（E对）破坏、溶解。NK细胞（D错）活性下降，并非大量减少。 HIV感染不会导致单核细胞（A错）、CD8⁺T细胞（B错）、粒细胞（C错）大量减少。